下列不属于药物性根尖周炎原因的是
A. 露髓处封亚砷酸时间过长
B. 亚砷酸用于年轻恒牙
C. 根管内放置酚类制剂过多
D. 根管内放置醛类制剂过多
E. 扩根管时器械超出根尖孔

正确答案：E。扩根管时器械超出根尖孔

解析：本题考查药物性根尖周炎的原因。扩根管时器械超出根尖孔（E错，为本题的正确答案）造成的损伤多表现为急性根尖周炎，为根管治疗并发症，不属于药物性根尖周炎原因。药物性根尖周炎顾名思义指由化学药物引起的根尖周炎症。亚砷酸（A对）对人体有害，作为牙髓失活剂时，封药不能超过规定时间，禁用于年轻恒牙（B对），因为砷剂易从开放的根尖孔进入牙根周围组织引起化学性灼伤，导致药物性根尖周炎。酚类制剂如甲醛甲酚渗透性强且有半抗原性，根管内放置酚类制剂过多（C对）易引起尖周、牙周组织的刺激，造成损伤。醛类制剂如戊二醛是非生物相容性药物，根管内放置醛类制剂过多（D对），也可造成根尖周组织损伤，引起炎症。